诊断左心室肥大的最基本条件是
A. 电轴左偏
B. 左室高电压
C. V₅V₆导联VAT>0.05s
D. ST-T改变
E. QRS波群时间延长达0.10～0.11s

正确答案：B。左室高电压

解析：左心室肥大的心电图特点是：①左心室高电压：胸导联，RV₅>2.5mV，RV₅+SV₁>4.0mV（男性）或>3.5mV（女性）；肢体导联：R1>1.5mV，RaVL>1.2mV，RaVF>2.0mV，RⅠ+SⅢ>2.5mV（B对）。②QRS波群时间轻度延长达0.10～0.11s，但一般<0.12s，V₅导联R峰时间>0.05s（CE错）。③心电轴左偏，多数≤一30°（A错）。④继发性ST-T改变：在V₅、V₆等以R波为主的导联中，ST段下移>0.05mV，T波低平、双向或倒置（D错）。